Meta分析中常见的偏倚不包括
A. 引用偏倚
B. 发表偏倚
C. 文献库偏倚
D. 失访偏倚
E. 多次发表偏倚

正确答案：D。失访偏倚

解析：Meta分析是对先前研究结果进行统计合并和评述的一种新方法，在文献查找和选择过程中，如果处理不当，会引入偏倚，导致合并后的结果歪曲了真实的情况。Meta分析过程中引入的偏倚有：发表偏倚（B对）、定位偏移、引用偏倚（A对）、多次发表偏倚（E对）和有偏倚的入选标准。其中定位偏倚又包括英语偏倚和文献库偏倚（C对）。失访偏倚只发生于随访性质的研究中，如队列研究、实验研究、预后观察等。失访原因主要是：有人不能坚持而退出队列（D错，为本题正确答案）。